属于β₂肾上腺素受体激动剂，具有平喘作用的药物有
A. 异丙托溴铵
B. 沙丁胺醇
C. 沙美特罗
D. 特布他林
E. 茶碱

正确答案：B、C、D。沙丁胺醇；沙美特罗；特布他林

解析：本题考查平喘药。属于β₂肾上腺素受体激动剂，具有平喘作用的药物有沙丁胺醇（B对）、沙美特罗（C对）、特布他林（D对）。按作用机制来分平喘药分可为六类：①β₂受体激动剂，包括沙丁胺醇、特布他林、沙美特罗等。②M胆碱受体阻断剂，如异丙托溴铵（A错）。③黄嘌呤类药物，如茶碱（E错）、氨茶碱、多索茶碱、二羟丙茶碱等。④过敏介质阻释剂，如肥大细胞膜稳定剂色甘酸钠，H₁受体阻断剂酮替芬等。⑤肾上腺皮质激素，如氢化可的松、布地奈德、氟替卡松、倍氯米松等，它们还有抗过敏作用。⑥白三烯调节剂，如孟鲁司特、扎鲁司特、普鲁司特等。